青光眼患者禁用的中药是
A. 闹羊花
B. 白附子
C. 马钱子
D. 洋金花
E. 千金子

正确答案：D。洋金花

解析：本题考查的是部分毒性中药品种的用法用量。青光眼患者禁用的中药是洋金花（D对）。洋金花的注意事项：孕妇、外感及痰热咳喘、青光眼、高血压及心动过速患者禁用。闹羊花（A错）的注意事项：不宜多服、久服。体虚者及孕妇禁用。白附子（B错）的注意事项：孕妇慎用；生品内服宜慎。马钱子（C错）的注意事项：孕妇禁用；不宜生用；不宜多服久服；运动员慎用；有毒成分能经皮肤吸收，外用不宜大面积涂敷。千金子（E错）的注意事项：孕妇禁用。